患儿，9岁。发热，双侧腮腺肿大9天。现头痛，呕吐。查体；体温39°，嗜睡，颈项强直。实验室检查：脑脊液蛋白定量20mg/dl，细胞数160×10⁶/L，以淋巴细胞为主。应首先考虑的是
A. 化脓性脑膜炎
B. 化脓性腮腺炎并发脑膜脑炎
C. 流行性腮腺炎并发脑膜脑炎
D. 结核性脑膜炎
E. 流行性腮腺炎并发胰腺炎

正确答案：C。流行性腮腺炎并发脑膜脑炎

解析：根据患儿双侧腮腺肿大故诊断为流行性腮腺炎。腮腺炎病毒除侵犯腮腺外，尚能引起脑膜炎、脑膜脑炎、睾丸炎、卵巢炎和胰腺炎等。脑膜脑炎一般发生在腮腺炎发病后4～5天，个别患儿脑膜炎先于腮腺炎。一般预后良好。临床主要表现为发热、头痛、呕吐、嗜睡、颈强直等，化验脑脊液白细胞总数正常或稍增高，以淋巴细胞为主。据患儿于流行性腮腺炎病程中出现头痛、呕吐、发热，查体：嗜睡，颈项强直，结合脑脊液结果，故诊断为流行性腮腺炎并发脑膜脑炎（C对）。化脓性脑膜炎（A错）临床主要以发热、头痛、呕吐、惊厥、意识障碍、颅内压增高、脑膜刺激征阳性及脑脊液脓性改变为特征。化脓性腮腺炎，多为一侧腮腺肿大，局部疼痛剧烈，拒按，红肿灼热明显，挤压腮腺时有脓液自腮腺管口流出，白细胞计数和中性粒细胞百分数明显增高（B错）。结核性脑膜炎（D错）常有结核接触史及其他部位结核病灶，起病多较缓慢，早期主要症状为小儿性格改变，中期因颅内压增高致剧烈头痛、喷射性呕吐、嗜睡或烦躁不安、惊厥等，出现明显脑膜刺激征，此期可出现颅神经障碍，眼底检查可见视乳头水肿、视神经炎或脉络膜粟粒状结核结节；晚期（昏迷期）1～3周，以上症状逐渐加重，由意识蒙眬，半昏迷继而昏迷，阵挛性或强直性惊厥频繁发作。流行性腮腺炎并发胰腺炎（E错）常发生于腮腺肿大数日后，表现为中上腹疼痛和压痛，伴有体温骤然上升、恶心和呕吐等症。B超提示胰腺肿大，脂肪酶升高有助于胰腺炎诊断。